青年女性，农民，头昏、心悸、颜面苍白5年，并感吞咽困难，血红蛋白45g/L，红细胞2.0×10¹²/L，白细胞及血小板正常，血片见红细胞大小不均，以小细胞为主，中心染色过浅，首选抗贫血制剂为
A. 维生素B12
B. 叶酸
C. 口服铁剂
D. 雄激素
E. 强的松

正确答案：C。口服铁剂

解析：根据此患者的实验室检查的血象结果可以判定为缺铁性贫血，其治疗的原则为根除病因；补足贮铁。对于补铁治疗应该首选口服铁剂。掌握“贫血概论及缺铁性贫血”知识点。